下列哪种药物能增加地高辛的血药浓度
A. 奎尼丁
B. 利多卡因
C. 苯妥英钠
D. 氯化钾
E. 呋塞米

正确答案：A。奎尼丁